女，34岁。突发右下胸痛，少量咯血2天。已婚，自然流产2次。查体：T37.5℃，P85次/分，右下肺叩诊呈浊音，呼吸音减弱，右下肢轻度肿胀。血常规：WBC8.8×10⁹/L，Hb124g/L，Plt64×10⁹/L。胸部X线片示右侧少量胸腔积液。该患者最可能的诊断是
A. 肺结核
B. 肺炎旁胸腔积液
C. 肺血管炎
D. 肺血栓栓塞症
E. 支气管肺癌

正确答案：D。肺血栓栓塞症

解析：患者青年女性，突发右下胸痛，少量咯血2天（急性肺栓塞的典型症状），自然流产2次（静脉血栓栓塞的危险因素），查体见T37.5℃（低热，腋温37.3～38℃为低热），右下肺叩诊呈浊音，呼吸音减弱，右下肢轻度肿胀（急性肺栓塞的典型体征）。血常规Plt64×10⁹/L（血小板计数降低，正常值100～300×10⁹/L）。胸部X线片示右侧少量胸腔积液，根据患者的病史、临床表现、实验室检查，应怀疑肺血栓栓塞（D对）。肺结核（A错）可有咯血，常有结核中毒症状：午后潮热、倦怠乏力、盗汗、食欲减退。胸部X线片可见结核浸润、增殖、干酪、纤维钙化病灶（P65）。肺炎旁胸腔积液和肺血管炎时可有肺部和全身感染症状，但无咯血、下肢肿胀症状（P42）（BC错）。支气管肺癌可以引起咳嗽，痰血或咯血，气短或喘鸣，发热，体重下降，胸痛胸水及胸外表现，X线可发现呈分叶状、毛刺、切迹等肺癌肿块，无下肢肿胀症状（E错）（P77）。